苦寒有毒，能伤胃损肝的药物是
A. 槟榔
B. 雷丸
C. 苦楝皮
D. 榧子
E. 使君子

正确答案：C。苦楝皮

解析：本题考查的是苦楝皮的使用注意。苦寒有毒，能伤胃损肝的药物是苦楝皮（C对）。苦楝皮：【使用注意】本品苦寒有毒，能伤胃损肝，故不宜过量或持续服用，脾胃虚寒、肝病患者、孕妇慎服。槟榔（A错）：【使用注意】本品行气、缓通大便，故脾虚便溏及气虚下陷者不宜服。雷丸（B错）：【使用注意】本品苦寒，脾胃虚寒者慎服。其杀虫成分为蛋白酶，受热（60℃左右）或酸作用下易被破坏失效，而在碱性环境中使用则作用最强，故入煎剂无驱绦虫作用。榧子（D错）：【使用注意】本品甘润滑肠，故不宜过量使用，肺热痰咳者忌服。使君子（E错）：【使用注意】本品大量服用可致呃逆、眩晕、呕吐等不良反应，故不宜超量服。若与热茶同服，亦可引起呃逆，故服药时忌饮茶。